假设某地随机抽取了100名45岁以上正常成年男性，测得收缩压均数为124.2mmHg，标准差为13.2mmHg，其标准差反映的是
A. 个体变异的大小
B. 抽样误差的大小
C. 系统误差的大小
D. 收缩压的平均水平
E. 收缩压变化的范围

正确答案：A。个体变异的大小